某男，54岁，曾确诊为冠心病。现猝然胸痛如绞，形寒，四肢不温，冷汗自出，心痛彻背，背痛彻心，心悸气短，舌质淡红，苔白，脉沉紧，宜用
A. 瓜萎薤白半夏汤合涤痰汤
B. 枳实薤白桂枝汤合当归四逆汤加减
C. 补阳还五汤加减
D. 血府逐瘀汤加减
E. 参附汤合右归丸加减

正确答案：B。枳实薤白桂枝汤合当归四逆汤加减

解析：诸阳受气于胸中而转行于背，寒邪内侵致阳气不运，气机痹阻，故见猝然胸痛如绞；阳气不足，机体失于温煦故见形寒，四肢不温，冷汗自出；寒凝不通则痛，故见心痛彻背，背痛彻心；胸阳不振，气机受阻，故见心悸气短；舌质淡红，苔白，脉沉紧，均为阴寒凝滞，阳气不运的表现；治法为辛温通阳，开痹散寒，方药选用枳实薤白桂枝汤合当归四逆汤加减（B对）。瓜萎薤白半夏汤合涤痰汤（A错）可以通阳泄浊，豁痰开痹，用于治疗痰浊内阻证。补阳还五汤加减（C错）可以益气活血，通脉止痛，用于治疗气虚血瘀证。血府逐瘀汤加减（D错）可以活血化瘀，通脉止痛，用于治疗心血瘀阻证。参附汤合右归丸加减（E错）可以益气壮阳，温经止痛，用于治疗心肾阳虚证。